下列除哪项外，均可引起血清钾增高
A. 急慢性肾功能衰竭
B. 静脉滴注大量钾盐
C. 严重溶血
D. 代谢性酸中毒
E. 代谢性碱中毒

正确答案：E。代谢性碱中毒

解析：高钾血症的病因很多，常见于（1）摄入过多如输入含钾溶液太快、太多（B对）、输入贮存过久的血液或大量使用青霉素钾盐等，可引起血钾过高。（2）肾排钾减少见于肾功能衰竭（A对）的少尿期和无尿期、肾上腺皮质机能减退等。（3）细胞内钾外移见于输入不相合的血液或其他原因引起的严重溶血（C对）、缺氧、酸中毒（D对）（E错，为本题正确答案）以及外伤所致的挤压综合症等。（4）细胞外液容量减少见于脱水、失血或休克所致的血液浓缩。